均可用抗毒素进行紧急预防的疾病是
A. 破伤风与结核病
B. 肠热症与波状热
C. 白喉与痢疾
D. 白喉与破伤风
E. 猩红热与风湿热

正确答案：D。白喉与破伤风